疑似输血引起的不良后果的，医患双方应共同对现场实物进行封存，封存的现场实物应由
A. 患者保管
B. 医疗机构保管
C. 患者和医疗机构共同委托的第三人保管
D. 患者和医疗机构任何一方均可以保管
E. 医疗机构所在地的卫生行政部门保管

正确答案：B。医疗机构保管

解析：疑似凝血引起的不良后果的，医患双方应共同对现场实物进行封存，封存的现场实物应由医疗机构保管（B对）。需要对现场实物检验时，如果患者和医疗机构无法共同指定合格的检验机构，这时由卫生行政部门（E错）指定。